古代人群中，根面龋最常发生的部位是
A. 近中面
B. 远中面
C. （牙合）面
D. 颊面
E. 邻面

正确答案：E。邻面

解析：本题考查龋病的临床表现与分类。在现代人群中，根面龋最常发生于牙根的颊面和舌面，而在古代人群中，根面龋损害主要在邻面（E对）。